某男，6岁。不思饮食，腹满喜按，神疲肢倦，大便稀溏腥臭，夹有不消化食物，面色萎黄，舌淡，苔白，脉濡细。宜选用的方剂是
A. 保和丸加减
B. 理中丸加减
C. 枳术丸加减
D. 健脾丸加减
E. 良附丸加减

正确答案：D。健脾丸加减

解析：本题考查的是积滞的辨证论治。不思饮食，腹满喜按，神疲肢倦，大便稀溏腥臭，夹有不消化食物，面色萎黄，舌淡，苔白，脉濡细。宜选用的方剂是健脾丸加减（D对）。积滞，是指小儿内伤乳食，停聚中焦，积而不化，气滞不行所致的疾病，以脘腹胀满、嗳气酸腐、不思乳食、食而不化、大便溏薄或秘结酸臭为临床特征。西医学的小儿消化不良表现为上述症状者，可参考此内容辨证论治。（一）乳食内积证：【症状】不思乳食，嗳腐酸馊，或呕吐食物、乳片，脘腹胀满疼痛，大便酸臭或便秘，烦躁啼哭，夜眠不安，手足心热。舌质红，苔白厚，或黄厚腻，脉弦滑，或指纹紫滞。【方剂应用】基础方剂为乳积用消乳丸（香附、神曲、麦芽、陈皮、砂仁、甘草）加减；食积用保和丸（山楂、神曲、半夏、茯苓、陈皮、连翘、莱菔子）加减（A错）。（二）脾虚夹积证：【症状】面色萎黄，形体消瘦，神疲肢倦，不思乳食，食则饱胀，腹满喜按，大便溏稀酸腥，夹有乳片或不消化食物残渣。舌质淡，苔白腻，脉细滑，或指纹淡滞。【方剂应用】基础方剂为健脾丸（人参、白术、陈皮、麦芽、山楂、神曲、枳实）加减。良附丸加减（E错）为胃痛寒邪客胃证的方剂应用。胃痛寒邪客胃证：【症状】胃痛暴作，喜温恶寒，得温痛减，口和不渴，或喜热饮。舌淡，苔薄白，脉弦紧。【方剂应用】基础方剂为良附丸（高良姜、香附）加减。方剂应用为理中丸加减（B错）或枳术丸加减（C错）的病证，2022年考试指南未明确说明。